心脏骤停的病理生理机制最常见的是
A. 心室颤动
B. 室性心动过速
C. 电机械分离
D. 第三度房室传导阻滞
E. 心室停顿

正确答案：A。心室颤动

解析：心脏骤停的病理生理机制最常见的是心室颤动（A对）。心室颤动时，心室丧失有效的整体收缩能力，而是被各部心肌快而不协调的颤动所代替，此时易发生心脏骤停。室性心动过速（B错）、电-机械分离（无脉性电活动）（C错）、第三度房室传导阻滞（D错）和心室停顿（E错）都可导致心脏骤停，但这四者并非最常见病理生理机制。